某地对中、小学生贫血患病情况进行调查，抽查小学生410名，有贫血患者120名；抽查中学生320名，有贫血患者58名。该资料属于
A. 配对计量资料
B. 成组计量资料
C. 成组分类资料
D. 配对分类资料
E. 等级资料

正确答案：C。成组分类资料